小儿夏季热的发病特点是
A. 发生于夏秋季节
B. 由感受暑邪而发病
C. 发热随气温而升降
D. 年长儿发病率较高
E. 连续数年发病且逐年加重

正确答案：C。发热随气温而升降

解析：夏季热又称暑热症，是婴幼儿在暑天发生的特有的季节性疾病，由于小儿体质不能耐受夏季炎暑而发，并非感受暑邪（B错）。发病季节集中于6、7、8，气温越高，发病率越高，且随着气温升高而病情加重，秋凉后，症状可自行消退（A错）（C对）。本病多见于6个月至3岁的婴幼儿，随着患儿年龄增长，体质增强，至次年夏季可不再发病（D错）。即使连续数年发病者，也有逐年减轻，逐渐向愈的趋势（E错）。